急性牙槽脓肿经何种排脓途径排脓后对患牙预后较差
A. 通过根管从龋洞排脓
B. 由龈沟或牙周袋排脓
C. 穿通舌侧骨壁排脓
D. 穿通唇颊侧骨壁排脓
E. 向鼻腔排脓

正确答案：B。由龈沟或牙周袋排脓

解析：本题考查急性化脓性根尖周炎的排脓途径。急性牙槽脓肿经由龈沟或牙周袋排脓（B对）对患牙预后较差。急性牙槽脓肿排脓途径有三种：①通过骨髓腔突破骨膜、黏膜或皮肤向外排脓：穿通骨壁突破黏膜、穿通骨壁突破皮肤、突破上颌窦壁一般不常见、突破鼻底黏膜；②通过根尖孔从冠部缺损处排脓，此种排脓方式对根尖周组织的破坏较小（A错）；③通过牙周膜从龈沟或牙周袋排脓，预后较差。通过颊舌侧壁排脓，导致骨量丧失，破坏较大（CD错）。当上颌中切牙牙槽突短而牙根长时，穿过唇侧骨壁，在鼻底黏膜下行成脓肿，破溃后向鼻腔排脓，破坏较大（E错）。但从龈沟或牙周袋排脓，牙周纤维遭受严重破坏，加重牙周病变，使牙齿更为松动，甚至患牙脱落，预后较差。